支配颞肌运动是
A. 迷走神经
B. 三叉神经
C. 舌咽神经
D. 面神经
E. 舌下神经

正确答案：B。三叉神经

解析：三叉神经（B对）支配咀嚼肌的运动，颞肌属于咀嚼肌。迷走神经（A错）主要分布到颈部、胸腔脏器和腹腔大部分脏器，支配这些器官的平滑肌、心肌和腺体的活动。舌咽神经（C错）主要传导舌后1/3的味觉。面神经（D错）主要支配表情肌。舌下神经（E错）支配舌内肌和大部分舌外肌。